妇女一生各阶段生理特点，下列哪项正确
A. 儿童期体格与内外生殖器同时发育
B. 新生女婴少量阴道流血警惕先天恶性肿瘤
C. 第一性征的出现，标志青春期开始
D. 月经初潮标志卵巢功能成熟为性成熟的开始
E. 绝经后的生命时期为绝经后期

正确答案：E。绝经后的生命时期为绝经后期

解析：妇女一生划分为胎儿期、新生儿期、儿童期、青春期、性成熟期、绝经过渡期和绝经后期7阶段。其中在新生儿期（出生后4周内）少量阴道出血属正常现象。儿童期（出生后4周-12岁左右）生殖器呈幼稚型。青春期（10～19岁）第二性征发育标志青春期开始。月经初潮为青春期的重要标志。绝经后期是指绝经后的生命时期。掌握“女性生殖系统生理”知识点。